男，35岁。2小时前突然呕鲜血约1000ml来院，2年前诊断为慢性乙型肝炎。查体：贫血貌，BP90/60mmHg，P120次/分，肝肋下未触及，脾肋下3cm。血红蛋白60g/L，红细胞2.6×10¹²/L，血小板60×10⁹/L，最有效的紧急止血措施是
A. 三腔二囊管压迫
B. 补充凝血因子
C. 口服止血药
D. 静脉注射生长抑素制剂
E. 冷盐水洗胃

正确答案：A。三腔二囊管压迫

解析：中年男性患者，既往有慢性乙型肝炎病史2年（肝硬化的高危人群），2小时前突然呕鲜血约1000ml（上消化道大出血，考虑为肝硬化后食管胃底静脉曲张出血）。查体：贫血貌，BP90/60mmHg（正常血压>90/60mmHg）、P120次/分（正常值为60～100次/分），血压降低、心率增快均为休克的表现。脾肋下3cm（脾大，考虑为肝硬化门静脉高压引起）。血红蛋白60g/L（正常值为120～160g/L）、红细胞2.6×10¹²/L（正常值为4.0～5.5×10¹²/L）、血小板60×10⁹/L（正常值为100～300×10⁹/L），重度贫血、血小板降低，考虑脾功能亢进。综合患者的病史、临床表现、实验室检查，初步诊断为肝硬化门静脉高压引起的食管胃底静脉曲张出血。由于本病出血量大、死亡率高，最有效的紧急止血措施是三腔二囊管压迫（A对），短暂止血效果肯定。补充凝血因子（B错）主要用于血友病的治疗。口服止血药（C错）、静脉注射生长抑素制剂（D错）、冷盐水洗胃（E错）可用于上消化道出血的治疗，但起效相对较慢。